有关胆囊的叙述,正确的是
A. 为腹膜间位器官
B. 位于肝脏面、左纵沟前部
C. 其底的体表投影为右旁正中线与右肋弓的交点处
D. 可分泌与浓缩胆汁
E. 胆囊的毗邻是右侧为胃幽门部、左侧为结肠右曲

正确答案：A。为腹膜间位器官

解析：胆囊为腹膜间位器官(A对)，位于右纵沟的前部(B错)，胆囊底的体表投影为右锁骨中线与右肋弓的交点(C错)，肝分泌胆汁而胆囊只贮存和浓缩(D错)，胆囊下侧位结肠右区(E错)。